Down综合征的特点不包括
A. 发育迟缓、智力低下
B. 常有上颌发育不足
C. 面部扁平，眶距增宽
D. 牙周破坏程度远不如菌斑、牙石等局部刺激的量
E. 严重的牙周炎

正确答案：D。牙周破坏程度远不如菌斑、牙石等局部刺激的量

解析：本题考查Down综合征。Down综合征的特点不包括牙周破坏程度远不如菌斑、牙石等局部刺激的量（D错，为本题的正确答案）。Down综合征的临床表现：患者有发育迟缓和智力低下（A对）。约1/2患者有先天性心脏病，约15%患儿于1岁前天折。面貌特征为面部扁平，眶距增宽（C对），鼻梁低宽，颈部短粗。常有上颌发育不足（B对）、萌牙较迟、错（牙合）畸形、牙间隙较大、系带附着位置过高等。几乎100%患者均有严重的牙周炎（E对），且其牙周破坏程度远超过菌斑、牙石等局部刺激的量。全口牙齿均有深牙周袋及炎症，下颌前牙较重，有时可有牙龈退缩，病情迅速加重，有时可伴坏死性龈炎。乳牙和恒牙均可受累。